预激综合征合并快速心房颤动的首选治疗药物是
A. 维拉帕米
B. 洋地黄
C. 利多卡因
D. 地尔硫䓬
E. 普罗帕酮

正确答案：E。普罗帕酮

解析：预激综合征合并快速心房颤动应选用延长房室旁路不应期的药物，首选治疗药物是普鲁卡因胺或普罗帕酮（E对），维拉帕米（A错）和地尔硫䓬（D错）同为非二氢吡啶类钙通道拮抗剂，与利多卡因（C错）一样，因会加速预激综合征合并快速心房颤动的心室率而慎用于预激综合征合并快速心房颤动患者。洋地黄（B错）可缩短旁路不应期而加快心房颤动时心房激动的下传，从而加快心室率，不应单独用于预激综合征合并快速心房颤动的患者。